临床上常用利多卡因进行表面麻醉的浓度是
A. 0.25%～1%
B. 0.5～1%
C. 0.005
D. 0.01
E. 2%～5%

正确答案：E。2%～5%

解析：表面麻醉临床应用较多的是2%～5%利多卡因和0.25%～0.5%的盐酸丁卡因。也可采用6%～20%的苯佐卡因或1%的盐酸达克罗宁行表面麻醉，但其麻醉作用不及丁卡因。掌握“颌面部常用局麻法及牙拔除的麻醉选择”知识点。